开具普通处方，其药物用量一般不超过的日数是
A. 10日
B. 2日
C. 3日
D. 5日
E. 7日

正确答案：E。7日

解析：普通处方其药物用量一般不超过7日（E对）；急诊处方一般不超过3日用量；对于某些慢性病、老年病或特殊情况，处方用量可适当延长，但医师应当注明理由。